下列哪项不是外科引流的适应证
A. 微小创口
B. 感染或污染创口
C. 止血不全的创口
D. 留有无效腔的创口
E. 渗液多的创口

正确答案：A。微小创口

解析：外科引流的适应证：感染或污染创口；渗液多的创口；留有无效腔的创口；止血不全的创口。掌握“口外手术打结、缝合及外科引流”知识点。